脾在志为
A. 怒
B. 喜
C. 忧
D. 思
E. 恐

正确答案：D。思

解析：脾在志为思，思指思虑，思由脾精、脾气化生，故为脾志（D对）。肝在志为怒（A错），怒是人在情绪激动时由肝之精气对外界环境刺激的应答而出现的正常情感反应。心在志为喜（B错），喜是心之精气对外界刺激的应答而产生的良性情绪反应。肺在志为忧（悲），忧、悲由肺精、肺气化生（C错）。肾在志为恐（E错），恐，是肾精、肾气对外在环境的应答而产生的一种恐惧、害怕的情志活动，亦为人之常性。